可导致肾病综合征合并急性间质性肾炎的药物是
A. 环磷酰胺
B. 钙通道阻滞剂
C. 青霉素
D. 非甾体抗炎药（NSAIDs）
E. 血管紧张素转换酶抑制剂

正确答案：D。非甾体抗炎药（NSAIDs）

解析：可导致肾病综合征合并急性间质性肾炎的药物是非甾体抗炎药（NSAIDs）（D对），因非甾体抗炎药（NSAIDs）与机体组织蛋白（载体）结合，诱发机体超敏反应（包括细胞及体液免疫反应），导致肾小管-间质炎症，同时还可导致肾小球微小病变，引发肾病综合征。环磷酰胺（A错）属于细胞毒性药物，可以用于肾病综合症的治疗，主要副作用为骨髓抑制剂中毒性肝损害，较少引起急性间质性肾炎。钙通道阻滞剂（B错）主要的副作用会引起心动过速、头痛和面色潮红，不会引起急性间质性肾炎。青霉素（C错）过去常引起急性间质性肾炎，但是一般不引起肾病综合征。血管紧张素转换酶抑制剂（E错）可用于肾病综合征减少尿蛋白，可引起肾功能一过性减退，以及高钾血症，但引起急性间质性肾炎较罕见。